下列关于低容量性高钠血症对机体的影响，哪项是不正确的？
A. 口渴
B. 细胞内液向细胞外液转移
C. 细胞外液容量增加
D. 尿少，尿比重增加
E. 醛固酮和ADH分泌增加

正确答案：C。细胞外液容量增加

解析：低容量性高钠血症即高渗性脱水，特点是失水多于失钠，细胞外液容量减少（C错，为本题正确答案），细胞外渗透压增高，刺激口渴中枢引起口渴（A对），细胞内液向细胞外液转移（B对）。细胞外液渗透压升高引起ADH分泌增加，加强水的重吸收因而尿量减少而尿比重增高（D对）细胞外液容量减少引起醛固酮分泌增加（E对）。